房室交界区传导减慢可导致
A. P波增宽
B. QRS波群增宽
C. T波增宽
D. P-R间期延长
E. ST段延长

正确答案：D。P-R间期延长